流行病学实验选择研究对象的原则不包括
A. 研究对象从实验中受益
B. 已知实验对其有害的人群不能作为实验对象
C. 选择预期发病率高的人群作为研究对象
D. 选择预期发病率低的人群作为研究对象
E. 选择依从者作为研究对象

正确答案：D。选择预期发病率低的人群作为研究对象